介于牙槽骨与牙根之间的致密结缔组织膜
A. 牙冠
B. 牙骨质
C. 牙质
D. 牙龈
E. 牙周膜

正确答案：E。牙周膜

解析：为介于牙槽骨与牙根之间的致密结缔组织膜是牙周膜(E对)。